下列关于健康与疾病的关系叙述不正确的是
A. 健康与疾病有着明确的界限
B. 健康具有多维性
C. 健康与疾病具有相对性
D. 健康是一个连续的动态过程
E. 没有绝对的健康也没有绝对的疾病

正确答案：A。健康与疾病有着明确的界限

解析：本题考查健康与疾病的关系。健康与疾病是相对的（C对）、动态变化的（D对），在一定条件下可相互转化；健康与疾病是动态的、辩证的、因人而异的，是在个体和医护人员共同努力下随时可以改变的（B对）。因此，健康与疾病没有明确的界限（A错，为本题正确答案），没有绝对的健康也没有绝对的疾病（E对）。